患者男，47岁，休克病人。中心静脉压4cmH₂O，血压60/40mmHg。该病人最可能发生休克的原因是
A. 血容量严重不足
B. 肾功能不全
C. 心功能不全
D. 肺功能不全
E. 容量血管过度舒张

正确答案：A。血容量严重不足

解析：本例休克患者为中年男性，由中心静脉压4cmH₂0（正常值5～10cmH₂O）以及血压60/40mmHg（正常值为90～139/60～89mmHg）可知该病人最可能发生休克的原因是血容量严重不足（A对）。肾功能不全（B错）、肺功能不全（D错）对中心静脉压影响较小。心功能不全（C错）患者中心静脉压常高于15cmH₂O。容量血管过度舒张（E错）常继发于心功能不全，中心静脉压常高于正常值。